黄芪桂枝五物汤与当归四逆汤组成中均含有的药物是
A. 生姜、芍药、桂枝
B. 大枣、桂枝、生姜
C. 黄芪、桂枝、芍药
D. 芍药、生姜、大枣
E. 桂枝、芍药、大枣

正确答案：E。桂枝、芍药、大枣

解析：本题考查黄芪桂枝五物汤与当归四逆汤的组成，属记忆内容内容。黄芪桂枝五物汤由黄芪、芍药、桂枝、生姜、大枣组成 。当归四逆汤由当归、桂枝、芍药、细辛、甘草、通草、大枣组成。二者均含有桂枝、芍药、大枣（E对）。趣记：当归四逆贵要（药）心痛甘枣。黄芪桂枝要（药）姜枣五物。